男，25岁，发现血尿、蛋白尿2年。查体：BP150/90mmHg，双下肢无水肿。实验室检查：尿蛋白定量0.5～0.8g/d，尿RBC5～10/HP，血Cr125μmol/L，血胆固醇6.0mmol/L。B超表示双肾大小正常。该患者最重要的治疗措施是
A. 注意休息
B. 控制血脂
C. 消除血尿
D. 控制血压
E. 低蛋白饮食

正确答案：D。控制血压

解析：青年男性患者（慢性肾炎好发人群），发现血尿蛋白尿2年。查体：BP150/90mmHg（1级高血压），双下肢无水肿。实验室检查：尿蛋白定量0.5～0.8g/d，尿RBC5～10/HP，血Cr125μmol/L【正常值（男）44～133μmol/L】，血胆固醇6.0mmol/L（正常值2.34～3.38mmol/L）。B超表示双肾大小正常。综合患者年龄、性别、临床表现及实验室检查，考虑该患者为慢性肾炎。慢性肾炎的治疗应积极控制高血压和减少尿蛋白以防止肾功能进一步恶化。因此该患者最重要的治疗措施是控制血压（D对）。注意休息（A错）、低蛋白饮食（E错）均是一般治疗。患者血脂稍有升高，但控制血脂（B错）只是一般的对症治疗，其重要性不如控制血压重要。在慢性肾小球肾炎的治疗中不刻意要求消除血尿（C错）。